评价疾病负担的指标为
A. 生命质量指数（PQLI）
B. 美国社会卫生协会指标（ASHA）
C. 健康期望寿命（ALE）
D. 减寿人年数（PYLL）
E. 调整病残生命年（DALY）

正确答案：E。调整病残生命年（DALY）

解析：本题考查评价疾病负担的指标。伤残调整生命年（DALY）（E对ABCD错）是疾病死亡损失健康生命年与疾病伤残（残疾）损失健康生命年相结合的指标，是评价疾病负担的指标。